属于中效苯二氮类的药物是
A. 地西泮
B. 奥沙西泮
C. 艾司唑仑
D. 三唑仑
E. 氟西泮

正确答案：C。艾司唑仑

解析：常用苯二氮䓬类药物分类及作用特点-中效类：阿普唑仑、艾司唑仑（C对）、劳拉西泮、氯硝西泮、硝西泮。